利用高频交变电场使水分子迅速获得热能而气化的干燥方法是
A. 常压箱式干燥
B. 流化床干燥
C. 冷冻干燥
D. 红外干燥
E. 微波干燥

正确答案：E。微波干燥

解析：本题考查微波干燥的原理。微波干燥（E对）：把物料置于高频交变电场内，从物料内部均匀加热，迅速干燥。